“阴阳离决，精气乃绝”所反映的阴阳关系是
A. 对立制约
B. 互根互用
C. 相互交感
D. 消长平衡
E. 相互转化

正确答案：B。互根互用

解析：阴阳离决指人体的阴阳失去相对平衡，一方过强或过弱，致另一方无法依存，无法再继续保持阴阳两者能动的相互平衡关系，出现离决，致使人体精气耗竭，生命终结，是阴阳相互依存，互为根本的体现，谁也离不开谁。对立制约是阴阳双方在一个统一体中的相互争斗、相互制约和相互排斥（A错）。互根互用是阴阳具有相互资生、促进，互为根本的关系（B对）。相互交感是阴阳二气在运动中相互感应而交合，即相互发生作用（C错）。消长平衡是指对立互根的阴阳处于不断增长和消减的变化之中，保持动态平衡（D错）。相互转化是阴阳在一定条件下可以向其相反的方向转化（E错）。